间接固位体与支点线关系最好的是
A. 与义齿游离端在支点线两侧，并远离支点线
B. 与义齿游离端在支点线同侧
C. 靠近支点线
D. 在支点线上
E. 利于美观

正确答案：A。与义齿游离端在支点线两侧，并远离支点线

解析：间接固位体与支点线的关系：支点线到游离端基托远端的垂直距离最好等于支点线到间接固位体的垂直距离。间接固位体距支点线的垂直距离愈远，对抗转动的力愈强。因为力×力臂=力矩，力臂越长，产生的力矩越大，所起的平衡作用也越好。远中游离端义齿的间接固位体应放置在前牙的舌隆突上，若远中游离端缺牙多，从间接固位体到支点线的垂直距离不可能远时，可用前牙区多基牙的联合支持，共同发挥间接固位作用。掌握“局部义齿人工牙及基托”知识点。